女，68岁。突发上腹阵发性绞痛2小时，短时间内寒战高热，小便呈浓茶样，随后嗜睡。查体：T39.6℃，P128次/分，R30次/分，BP80/50mmHg。神志不清，躁动，巩膜黄染，右上腹肌紧张，有压痛和反跳痛。以下非手术治疗措施中，错误的是
A. 持续吸氧
B. 联合使用足量抗生素
C. 纠正水、电解质紊乱
D. 输注2个单位红细胞
E. 禁食、胃肠减压

正确答案：D。输注2个单位红细胞

解析：老年女性患者，上腹绞痛，寒战高热，巩膜黄染（黄疸），血压80/50mmHg（休克），神志不清、躁动（中枢神经系统抑制现象），为典型的Reynolds五联征，应诊断为急性梗阻性化脓性胆管炎（AOSC）。AOSC患者休克属于感染性休克，不是失血引起的，无需输注红细胞（D错，为本题正确答案），可选用晶体液、胶体液扩充血容量。持续吸氧（A对）有助于缓解患者体内低氧状态。联合使用足量抗生素（B对）有助于抗感染。纠正水、电解质紊乱（C对）有助于保持内环境稳定。禁食、胃肠减压（E对）可减少胃酸分泌，使胆囊收缩素减少，可减轻病情。